与50S亚基结合，阻断转肽作用的药物是
A. 青霉素
B. 磺胺甲噁唑
C. 甲氧苄啶
D. 红霉素
E. 异烟肼

正确答案：D。红霉素

解析：本题考查红霉素的作用机制。红霉素（D对）可与细菌核糖体的50S亚基结合，竞争性阻断了肽链延伸过程中的肽基转移作用与（或）移位作用，终止蛋白质的合成。磺胺甲噁唑（B错）为磺胺类抗菌药，磺胺药的化学结构与PABA类似，能与PABA竞争二氢叶酸合成酶，影响了二氢叶酸的合成。青霉素（A错）主要通过抑制细菌细胞壁的合成发挥抗菌作用。甲氧苄啶（C错）主要抑制二氢叶酸还原酶发挥抗菌作用。异烟肼（E错）主要通过抑制分枝菌酸的合成发挥抗菌作用。